子宫内膜癌确诊依靠
A. 子宫输卵管碘油造影检査
B. B型超声检查
C. CT检查
D. 宫腔镜检查
E. 分段诊刮病理学检查

正确答案：E。分段诊刮病理学检查

解析：子宫内膜癌确诊依靠分段诊刮病理学检查（E对）。如果临床或影像学检查怀疑子宫内膜癌，应行分段诊刮病理学检查，明确诊断。子宫输卵管碘油造影（P429）（A错）多用于了解输卵管是否通畅、阻塞部位及宫腔形态。B型超声检查（P315）（B错）可了解子宫大小、宫腔形状、宫腔内有无赘生物、子宫内膜厚度、肌层有无浸润及深度，可对异常阴道流血的原因作出初步判断并为进一步检查的选择提供参考，不作为确诊手段。CT检查（P316）（C错）可协助判断有无子宫外转移。宫腔镜检查（P316）（D错）可直接观察宫腔及宫颈管内有无癌灶存在，癌灶大小及部位，直视下取材活检，对局灶型子宫内膜癌的诊断更为准确，可用于刮宫阴性，但高度怀疑子宫内膜癌者。